希恩综合征是由于
A. 肾上腺皮质坏死引起的
B. 肾上腺髓质坏死导致的
C. 垂体坏死导致的
D. 下丘脑坏死导致的
E. 大脑皮质坏死导致

正确答案：C。垂体坏死导致的

解析：垂体坏死导致的（C对D错）是希恩综合征。肾上腺皮质坏死引起的是沃－弗综合征（AB错）。大脑皮质坏死导致（E错）神志模糊、嗜睡、昏迷、惊厥等症状，这可能与微血管阻塞，蛛网膜下腔、脑皮质、脑干等出血有关。